女性，28岁，已婚，近4个月来月经10～12天/28～30天，经量每次用卫生斤12条，妇科检查及B超检查无异常，基础体温呈双相型，于经行数天后缓慢下降，月经第5天子宫内膜检查呈分泌反应。其诊断是
A. 月经过多，无排卵型功能失调性子宫出血
B. 月经过多，黄体功能不全
C. 经期延长，无排卵型功能失调性子宫出血
D. 经期延长，子宫内膜脱落不全
E. 经期延长，排卵期出血

正确答案：D。经期延长，子宫内膜脱落不全

解析：子宫内膜不规则脱落是由于下丘脑-垂体-卵巢轴调节功能紊乱，或溶黄体机制失常，引起黄体萎缩不全，而内膜持续受孕激素影响，不能如期完整脱落。正常月经第3～4 日时，分泌期子宫内膜已全部脱落。黄体萎缩不全时，月经期第5～6日仍能见到呈分泌反应的子宫内膜，常表现为残留的分泌期内膜与出血坏死组织及新增生的内膜混合共存（D对）；无排卵性异常子宫出血主要是不规则子宫出血，常表现为月经周期紊乱，经期长短及出血量不一，可点滴出血，亦可大量出血。出血量多或时间长时可继发贫血，伴有乏力、头晕、心悸等症状，甚至出现失血性休克（AC错）；黄体功能不足表现为月经周期缩短，有时周期虽在正常范围内，但卵泡期延长，黄体期缩短，常伴不孕或孕早期流产（B错）；排卵期出血表现为规律的两次月经间期出血，一般<7天，量少（E错）。